为了研究45岁以上的男性中体重指数（BMI）≥25者是否糖尿病患病率高，某医生共调查了9550人，其中BMI≥25者有2110人（n1），糖尿病患病人数为226人（X1）；BMI＜25者7440人（n2），其中糖尿病患病人数为310人（X2），问BMI≥25者糖尿病患病率是否高于BMI＜25者。若进行μ检验，公式为
A. |P₁-P₂|/SP₁₋P₂
B. |p-π|/Sp
C. |p1-p2|/σp
D. |p1-p2|/Sp
E. |p-π|/σp

正确答案：A。|P₁-P₂|/SP₁₋P₂

解析：两个大样本的总体率的假设检验，即通过样本率P₁与P₂来推断π₁与π₂的关系。用μ检验的方法来进行二项分布两样本总体率的比较，则统计量μ的计算公式为|P₁-P₂|/SP₁₋P₂（A对）。